使用乌头类药物引起中毒的原因有
A. 过量服用
B. 泡酒服用
C. 使用生品
D. 煎煮时间太短
E. 个体差异引起蓄积性中毒

正确答案：A、B、C、D、E。过量服用；泡酒服用；使用生品；煎煮时间太短；个体差异引起蓄积性中毒

解析：本题考查的是乌头类药物引起中毒的原因。使用乌头类药物引起中毒的原因有过量服用（A对）、泡酒服用（B对）、使用生品（C对）、煎煮时间太短（D对）与个体差异引起蓄积性中毒（E对）。乌头类药物引起中毒原因：1.过量服用为主要原因。2.用法不当，如煎煮时间太短或生用。3.泡酒服用。4.个体差异引起蓄积性中毒。